施行肠外营养最严重的并发症是
A. 气胸
B. 空气栓塞
C. 低钾血症
D. 高血糖致高渗性非酮性昏迷
E. 导管性脓毒症

正确答案：B。空气栓塞

解析：肠外营养可发生营养补充过程中的代谢性并发症，如糖代谢异常、电解质紊乱等。由于肠外营养需通过中心静脉置管完成，亦可引起导管脓毒症、气胸、血栓形成等并发症。但最严重的是空气栓塞，是罕见但致命的并发症（B对）。